新生儿败血症的主要治疗是
A. 碳酸氢钠
B. 地塞米松
C. 苯巴比妥
D. 头孢他啶
E. 地高辛

正确答案：D。头孢他啶

解析：新生儿败血症应立即使用抗生素治疗，本题中抗生素只有头孢他啶（D对）。碳酸氢钠（A错）用于纠正酸中毒。地塞米松（B错）可抑制炎症反应，使病情加重，不宜使用。苯巴比妥（C错）为镇静催眠药且副作用较大，不宜使用。地高辛（E错）为强心剂，不是新生儿败血症的常用药。